50岁女性，孕5产5，绝经3年，阴道不规则流血1月。妇科检查：外阴阴道正常，宫颈肥大糜烂触之易出血，子宫后屈稍小，双侧附件未见异常。该病人绝经后最可能的出血原因是
A. 子宫颈炎
B. 子宫颈癌
C. 子宫内膜癌
D. 子宫颈尖锐湿疣
E. 子宫内膜炎

正确答案：B。子宫颈癌

解析：患者为中老年妇女，绝经后出现阴道不规则流血（宫颈癌老年患者常为绝经后不规则阴道流血）。妇检：外阴阴道正常，宫颈肥大糜烂触之易出血（接触性出血），子宫后屈稍小，双侧附件未见异常，首先考虑为子宫颈癌（B对）。子宫颈炎（A错）有症状者主要表现为阴道分泌物增多，呈黏液脓性，阴道分泌物刺激可引起外阴瘙痒及灼热感，此外可出现经间期出血、接触后出血等症状。子宫内膜癌（C错）早期最常见的症状是绝经后阴道不规则流血。子宫颈尖锐湿疣（P104）（D错）临床表现主要是外阴瘙痒，灼痛或性交后疼痛不适，体检可见散在或簇状增生的粉色或白色小乳头状疣，无阴道不规则流血。子宫内膜炎（P227）（E错）常表现为阴道大量脓性分泌物，且有臭味。